男性，65岁，慢性咳嗽、咳痰20年。4天前受凉后咳嗽加重，痰量增多，咳黏脓痰。此时最合理的治疗
A. 免疫治疗
B. 中药治疗
C. 抗炎祛痰
D. 解痉平喘
E. 补充电解质

正确答案：C。抗炎祛痰